京大戟和红大戟的共有功效是
A. 峻下冷积
B. 泻水逐饮
C. 消肿散结
D. 祛痰利咽
E. 破血消癥

正确答案：B、C。泻水逐饮；消肿散结

解析：本题考查的是京大戟与红大戟的功效。京大戟和红大戟的共有功效是泻水逐饮（B对）与消肿散结（C对）。京大戟：【功效】泻水逐饮，消肿散结。红大戟：【功效】泻水逐饮，消肿散结。峻下冷积（A错）是大黄配巴豆、干姜的功效。大黄配巴豆、干姜：大黄苦寒，功善泻热通便、攻积导滞；巴豆辛热，功善峻下冷积；干姜辛热，功善温中散寒。三药相配，巴豆得大黄，其泻下之力变缓和而持久；大黄得巴豆，其寒性可去；再加温中散寒之干姜，以助散寒之力。故善治寒积便秘。桔梗：【功效】宣肺，利咽，祛痰（D错），排脓。千金子：【功效】泻水逐饮，破血消癥（E错）。